下列哪项不是人们最佳睡眠时间
A. 子时
B. 丑时
C. 巳时
D. 寅时
E. 卯时

正确答案：C。巳时

解析：巳时指上午9时至上午11时，不是最佳睡眠时间（C错，为本题正确答案）。晚间11点至凌晨1点（子时），胆经运行最旺，适宜睡眠（A错）；丑时指凌晨1点至3点，肝经旺，适宜睡眠（B错）；寅时指凌晨3～5点，肺经运行旺，适宜睡眠（D错）；卯时指凌晨5点到7点，大肠经旺，适宜睡眠（E错）。